体现有利原则的是
A. 杜绝对病人的有意伤害
B. 选择受益最大、损伤最小的治疗方案
C. 患者及家属无法实行知情同意时医生可以行使家长权
D. 对病人一视同仁
E. 合理筛选肾脏移植受术者

正确答案：B。选择受益最大、损伤最小的治疗方案

解析：这一原则要求医务人员的行为对患者确有助益，而且在利害共存的情况下进行权衡。掌握“医学伦理的基本原则”知识点。